受体的特性包括
A. 饱和性
B. 特异性
C. 可逆性
D. 高灵敏性
E. 多样性

正确答案：A、B、C、D、E。饱和性；特异性；可逆性；高灵敏性；多样性

解析：本题考查受体的特性。受体的特性：1.饱和性（A对）；2.特异性（B对）；3.可逆性（C对）；4.灵敏性（D对）；5.多样性（E对）。